治疗心力衰竭可选用的药物是
A. 普罗帕酮
B. 噻氯匹定
C. 洛伐他汀
D. 多巴酚丁胺
E. 米诺地尔

正确答案：D。多巴酚丁胺

解析：本题考查多巴酚丁胺。多巴酚丁胺（D对）属于β受体激动剂，可用于对多巴胺不耐受或无效的心力衰竭。普罗帕酮（A错）属于Ⅰc类抗心律失常药。噻氯匹定（B错）用于血栓闭塞性脉管炎、闭塞性动脉硬化等循环障碍及血管手术和体外循环产生的血栓。洛伐他汀（C错）用于防治动脉粥样硬化和冠心病。米诺地尔（E错）可降低血压，可治疗男性型秃发及斑秃。